某市夏季某天突发多起食物中毒案例。患者表现为恶心、呕吐、腹痛和腹泻，多数患者表现为剧烈而频繁地呕吐，严重者甚至出现虚脱和严重失水等现象。经调查，患者几小时前均在同一饭店进食。最可能是
A. 沙门菌食物中毒
B. 变形杆菌属食物中毒
C. 葡萄球菌肠毒素食物中毒
D. 副溶血性弧菌食物中毒
E. 肉毒梭菌毒素食物中毒

正确答案：C。葡萄球菌肠毒素食物中毒